对先天性巨结肠，既简单又具有诊断价值的检查是
A. 钡剂灌肠
B. 直肠黏膜活组织检查
C. 肌电图检查
D. 腹部立位X线平片
E. 直肠肛门测压

正确答案：D。腹部立位X线平片

解析：腹部立位X线平片（D对）可通过扩张充气的结肠影或结肠梗阻判断先天性巨结肠，方法简单快捷，具有诊断价值。少量钡剂灌肠（A错）可以了解痉挛段的长度和排钡功能，钡剂24小时后仍有残留是巨结肠的佐证。直肠粘膜活组织检查（B错）可以诊断先天性巨结肠，但方法复杂。肌电图检查（C错）对于先天性巨结肠诊断没有意义。直肠肛门测压（E错）是检查先天性巨结肠有效的方法。